高尿酸血症血液中血尿酸
A. ≥416μmol/L
B. ≥516μmol/L
C. ≥616μmol/L
D. ≥716μmol/L
E. ≥816μmol/L

正确答案：A。≥416μmol/L

解析：痛风主要临床表现为高尿酸血症，是嘌呤代谢障碍，尿酸生成增多或（和）尿酸排泄减少导致血清尿酸水平浓度高于420μmol/L的疾病、急慢性关节炎、痛风石、尿酸性尿路结石等。高尿酸血症的诊断标准：正常嘌呤饮食状态下，非同日两次空腹SUA水平：男性和绝经后女性血尿酸＞420μmol/L，绝经前女性＞350μmol/L（BCDE错）。